根据《国家药品监督管理局职能配置、内设机构和人员编制规定》，国家药品监督管理局的职责包括
A. 负责执业药师资格准入管理
B. 负责制定医疗器械生产质量管理规范并依职责监督实施
C. 负责化妆品标准管理和安全监督管理
D. 负责保健食品标准制定和监督管理

正确答案：A、B、C。负责执业药师资格准入管理；负责制定医疗器械生产质量管理规范并依职责监督实施；负责化妆品标准管理和安全监督管理

解析：本题考查的是国家药品监督管理局的职责。根据《国家药品监督管理局职能配置、内设机构和人员编制规定》，国家药品监督管理局的职责包括负责执业药师资格准入管理（A对）、负责制定医疗器械生产质量管理规范并依职责监督实施（B对）、负责化妆品标准管理和安全监督管理（C对）。根据《国家药品监督管理局职能配置、内设机构和人员编制规定》，国家药品监督管理局（简称NMPA）贯彻落实党中央关于药品监督管理工作的方针政策和决策部署，在履行职责过程中坚持和加强党对药品监督管理工作的集中统一领导。主要职责是：（1）负责药品（含中药、民族药，下同）、医疗器械和化妆品安全监督管理。（2）负责药品、医疗器械和化妆品标准管理。（3）负责药品、医疗器械和化妆品注册管理。（4）负责药品、医疗器械和化妆品质量管理。（5）负责药品、医疗器械和化妆品上市后风险管理。（6）负责执业药师资格准入管理。（7）负责组织指导药品、医疗器械和化妆品监督检查。（8）负责药品、医疗器械和化妆品监督管理领域对外交流与合作，参与相关国际监管规则和标准的制定。（9）负责指导省、自治区、直辖市药品监督管理部门工作。（10）完成党中央、国务院交办的其他任务。（11）职能转变。